以下有关类风湿因子（RF）的描述，哪一项是错误的
A. AF是一种抗自身变性IgG的抗体
B. 主要用于风湿性疾病的疗效观察
C. 系统性红斑狼疮时可呈阳性
D. AF可用胶孔凝集试验检测
E. 类风湿性关节炎患者RF阳性率较高

正确答案：B。主要用于风湿性疾病的疗效观察

解析：RF主要为IgM类自身抗体，但也有IgG类、IgA类和IgE类。各类RF临床意义有所不同。RF是一种以变性IgG为靶抗原的自身抗体（A对）。未经治疗的类风湿性关节炎患者其阳性率为80%（E对），且滴定度常在1：160以上。临床上动态观察滴定度多少，可作为病变活动及药物治疗后疗效的评价。其他风湿性疾病如SLE阳性率为20%—25%（C对）；硬皮病与皮肌炎阳性率为10%—24%，滴定度较低。RF的测定常用胶孔凝集试验检测（D对）（RF是一种主要发生于类风湿性关节炎患者体内的抗人变性IgG抗体，可与IgG的Fc段结合。将变性IgG包被于聚苯乙烯胶乳颗粒上，此致敏胶乳在与待测血清中的RF相遇时，即可发生肉眼可见的凝集）。RF不反映风湿性疾病的疗效（B错，为本题正确答案），其滴度也不反映风湿病的严重程度，滴度越高，越代表疾病处于活动期。